以下不属于可摘局部义齿适应症的是
A. 游离端缺失的患者
B. 牙列缺损过渡性修复
C. 伴有软组织缺损者
D. 化妆性义齿
E. 未治愈的口腔黏膜病患者

正确答案：E。未治愈的口腔黏膜病患者

解析：有口腔黏膜病变或其他软硬组织病变，未治愈或未得到有效控制的患者，是可摘局部义齿的禁忌证。答案为E。掌握“局部义齿的适应证与禁忌证”知识点。